以下有关氢氧化钙制剂的论述中,不恰当的是
A. 对牙髓的刺激性小
B. 可促进修复性牙本质的生成
C. 有一定的抗菌、抗炎性能
D. 溶解度是垫底材料中最大者
E. 有良好的隔垫性，能隔绝电的传导

正确答案：E。有良好的隔垫性，能隔绝电的传导

解析：本题考查氢氧化钙水门汀。以下有关氢氧化钙制剂的论述中,不恰当的是有良好的隔垫性，能隔绝电的传导（E错，为本题的正确答案）。氧化钙的抗压强度为5.5MPa，与氧化锌丁香油粘固粉相似，对牙髓的刺激性小（A对），可促进修复性牙本质的生成（B对）；高钙离子浓度，可促进钙盐的沉积；强碱性，有一定的抗菌、抗炎性能（C对）；有良好的隔垫性，但不能隔绝电的传导；溶于唾液，溶解度是垫底材料中最大者（D对）。